肺部疾病痊愈时，容易完全恢复组织正常的结构和功能的疾病是
A. 慢性支气管炎
B. 大叶性肺炎
C. 小叶性肺炎
D. 病毒性肺炎
E. 慢性肺气肿

正确答案：B。大叶性肺炎

解析：大叶性肺炎（B对）的自然病程大致1～2周，可经充血水肿期、红色肝样变期、灰色肝样变期和溶解消散期四个时期，溶解消散期时，肺内炎症灶完全溶解消散后，可完全恢复肺组织正常的结构和功能。慢性支气管炎（P169）（A错）和慢性肺气肿（E错）均为慢性过程，病变易反复发作，不易痊愈。小叶性肺炎（P166）（C错）属于急性化脓性炎症，支气管和肺组织易遭到破坏，不容易完全恢复。病毒性肺炎（D错）可由多种病毒混合感染引起，病情较重，病灶肺组织可遭到破坏且不易完全恢复。